男，55岁。高血压5年，头痛频繁发作1年。嗜烟酒，肥胖。血糖轻度升高。超声心动图示左心室壁轻度增厚，降压宜首选的药物是
A. 硝苯地平
B. 普萘洛尔
C. 氢氯噻嗪
D. 依那普利
E. 哌唑嗪

正确答案：D。依那普利

解析：患者中年男性，高血压5年，头痛频繁发作1周，嗜烟酒，肥胖。血糖轻度升高。超声心动图示左心室壁轻度增厚，依那普利（D对）可用于治疗高血压及慢性心功能不全，长期应用时，能减轻左心肥厚和改善大动脉的顺应性。硝苯地平（A错）、普萘洛尔（B错）、氢氯噻嗪（C错）及哌唑嗪（E错）均适用于肥胖高血压患者治疗，疗效不及血管紧张素转换酶且副作用大，不作首选。